引起移植排斥反应最重要的抗原是
A. Rh血型抗原
B. ABO血型抗原
C. 异嗜性抗原
D. HLA抗原
E. 变应原

正确答案：D。HLA抗原